患者，男，80岁，因发热、咳嗽、咳痰2天就诊，诊断为社区获得性肺炎，给予左氧氟沙星、甘草合剂、氨溴索、对乙酰氨基酚、维生素C等治疗。患者用药3天后出现失眠、烦躁不安等症状，最可能引起该症状的药物是
A. 甘草合剂
B. 氨溴索
C. 对乙酰氨基酚
D. 左氧氟沙星
E. 维生素C

正确答案：D。左氧氟沙星

解析：本题考查药物的不良反应。患者用药3天后出现失眠、烦躁不安等症状，最可能引起该症状的药物是左氧氟沙星（D对）。喹诺酮类药物具有中枢神经不良反应，表现为失眠、烦躁不安等症状，甚至可诱发癫痫。甘草合剂（A错）有微弱的恶心，呕吐反应。氨溴索（B错）的不良反应可有上腹部不适、纳差、腹泻，腿疼，偶见皮疹。对乙酰氨基酚（C错）可引起急性实质性肝损伤。维生素C（E错）不宜长期过量服用，否则突然停药可能出现坏血病症状。